被毒蛇咬伤后，应用越早效果越好的药物是
A. 肾上腺皮质激素
B. 抗生素
C. 呼吸兴奋剂
D. 升压药
E. 抗蛇毒血清

正确答案：E。抗蛇毒血清

解析：抗蛇毒血清（E对）特异性较高，效果确切，应用越早则疗效越好。毒蛇咬伤后防治感染：常规使用破伤风抗毒素及抗菌药物（B错）。毒蛇咬伤后危重病症的抢救：①呼吸衰竭的处理：一旦出现气促、呼吸困难、呼吸表浅而快等症状，应立即给氧，并可视情况使用呼吸中枢兴奋药（C错）；②急性肾衰竭的处理：早期肾衰竭可选用甘露醇或速尿，当尿量增多时可重复使用。严重时可应用利尿合剂和肾上腺皮质激素（A错）。